进入收肌管的神经是
A. 隐神经
B. 胫神经
C. 闭孔神经皮支
D. 生殖股神经
E. 股神经肌支

正确答案：A。隐神经

解析：隐神经（A对）伴随股动脉进入收肌管下行。胫神经（B错）为坐骨神经本于的延续，在股后区下份沿中线下行进入腘窝，其后与位于深面的腘血管相伴下行至小腿后区、比目鱼肌深面，继而伴胫后血管行至内踝后方，最后在屈肌支持带深面的踝管内分为足底内侧神经和足底外侧神经两终支进入足底区。闭孔神经皮支（C错）自腰丛发出后从腰大肌外侧缘穿出，紧贴盆壁内面前行，与闭孔血管伴行穿闭膜管出盆腔。生殖股神经（D错）自腰大肌前面穿出后，在该肌的前面下行，不久斜越输尿管的后方行至腹股沟区，在腹股沟韧带上方分为生殖支和股支。股神经肌支（E错）自腰大肌外侧缘发出后，在腰大肌与骼肌之间下行到达腹股沟区，随后在腹股沟韧带中点稍外侧从深面穿经该韧带，于股动脉的外侧进入大腿的股三角区。